既能治疗风湿性关节炎，又有抗血栓形成作用的药物是
A. 肝素
B. 布洛芬
C. 阿司匹林
D. 喷他佐辛
E. 哌替啶

正确答案：C。阿司匹林

解析：本题考查阿司匹林药理作用与临床应用。既能治疗风湿性关节炎，又有抗血栓形成作用的药物是阿司匹林（C对）。肝素（A错）可用于血栓栓塞性疾病、弥散性血管内凝血（DIC）、防治心肌梗死、脑梗死、心血管手术及外周静脉术后血栓形成、体外抗凝。布洛芬（B错）属于丙酸类非甾体抗炎药，有明显的抗炎、解热、镇痛作用，临床主要用于风湿性关节炎、骨关节炎、强直性关节炎、急性肌腱炎、滑液囊炎等，也可用于痛经的治疗。喷他佐辛（D错）为阿片受体部分激动剂，适用于各种慢性疼痛。哌替啶（E错）为阿片受体激动剂，可用于镇痛、心源性哮喘、麻醉前给药及人工冬眠。